除另行规定外，浓缩水蜜丸中水分不得超过
A. 0.06
B. 0.09
C. 0.12
D. 0.15
E. 0.18

正确答案：C。0.12

解析：本题考查的是丸剂的所含水分的要求。除另行规定外，浓缩水蜜丸中水分不得超过12%（C对）。除另有规定外，蜜丸和浓缩蜜丸中所含水分不得过15.0%（D错）；水蜜丸和浓缩水蜜丸不得过12.0%；水丸、糊丸、浓缩水丸不得过9.0%（B错）。蜡丸不检查水分。